规范文化影响人类健康的主要途径是
A. 支配人类的行为生活方式
B. 影响人类的生活环境
C. 干扰人们的心理过程
D. 提高卫生资源的使用效率
E. 影响人类的劳动条件

正确答案：A。支配人类的行为生活方式

解析：本题考查规范文化影响人类健康的主要途径。规范文化包括社会制度、教育、法律、风俗习惯、伦理道德等，主要通过支配行为生活方式（A对BCDE错）来影响人群健康。